某地对伤寒、副伤寒甲、乙三联菌苗的效果进行评价，观察资料统计如下（地区人口稳定）。其效果指数和保护率依次为
A. 100，99%
B. 99%，100
C. 110，99%
D. 99%，110
E. 100，90%

正确答案：A。100，99%